男，28岁。因间断发热5天，于8月底来诊。6天前由广州到哈尔滨，次日出现寒战、发热、头痛，服退热药热退，2天后再次高热，持续数小时，大汗后退热，伴乏力，精神差。实验室检查：WBC6.5x10⁹/L，L0.40。可能的诊断是
A. 血吸虫病
B. 伤寒
C. 流行性乙型脑炎
D. 疟疾
E. 败血症

正确答案：D。疟疾

解析：中年男性患者，间断发热、头痛5天，次日出现寒战、发热、头痛，服退热药热退，2天后再次高热，持续数小时，大汗后退热，伴乏力，精神差（疟疾典型症状，周期性发作），6天前由广州到哈尔滨（疫区接触史），实验室检查：血WBC6.5×10⁹/L，淋巴细胞0.40，综上所述，该患者最可能的诊断是疟疾（D对）。血吸虫病急性期患者有发热、腹痛、腹泻或脓血便，肝大与压痛等，血中嗜酸性粒细胞显著增多（A错）。伤寒患者一般有全身毒血症状，临床表现根据累及器官的不同而不同（B错）。流行性乙型脑炎临床上以高热、意识障碍、抽搐、病理反射及脑膜刺激征为特征（C错）。溶血性贫血一般有黄疸，高胆红素血症（E错）。